评价水质清洁度和考核净化效果的指标是
A. 菌落总数
B. 总大肠菌群
C. 耐热大肠菌群
D. 大肠埃希氏菌
E. 隐孢子虫

正确答案：A。菌落总数

解析：本题考查评价水质清洁度和考核净化效果的指标。菌落总数（A对BCDE错）是评价水质清洁度和考核净化效果的指标。菌落总数增多说明水受到了微生物污染，但不能识别其来源，必须结合总大肠菌群指标来判断污染来源及安全程度。我国现行饮用水卫生标准规定菌落总数≤100CFU/ml。